女，30岁，人工流产后发热伴下腹疼痛20天。查体：宫颈举痛，子宫后位，正常大小，触痛明显。右侧宫旁明显增厚，压痛。盆腔超声检查：子宫大小正常，右宫旁可探及不均质混合回声包块，大小约5.0×2.5cm，边界欠清。最可能的诊断是
A. 急性盆腔炎
B. 盆腔结核
C. 卵巢肿瘤蒂扭转
D. 急性阑尾炎
E. 黄体破裂

正确答案：A。急性盆腔炎

解析：该患者为青年女性，行人工流产术后（急性盆腔的高危因素包括刮宫术）出现发热、下腹痛（病情严重者可表现为急性病容，体温升高，心率加快，下腹部有压痛、反跳痛及肌紧张），查体：宫颈举痛，触痛明显，右侧宫旁明显增厚，压痛（妇检可有宫颈举痛、附件区压痛），超声检查：右宫旁可探及不均质混合回声包块，边界欠清，最可能的诊断是急性盆腔炎（A对）。盆腔结核（P266）（B错）会出现不孕、月经失调、以及结核中毒症状；卵巢肿瘤蒂扭转（P323）（C错）常在体位改变时突然发生一侧下腹剧痛，常伴恶心呕吐甚至休克；急性阑尾炎（D错）表现为转移性右下腹疼痛；黄体破裂（P55）（E错）表现下腹一侧突发性疼痛，一侧附件区压痛。以上四种疾病均无宫颈举痛，宫旁压痛。